苯海索治疗帕金森病的作用机制主要是
A. 激动黑质-纹状体通路的多巴胺受体
B. 抑制外周左旋多巴脱羧转变成多巴胺
C. 促进中枢释放多巴胺
D. 阻断中枢纹状体的胆碱能受体
E. 阻断外周的胆碱能受体

正确答案：C。促进中枢释放多巴胺